属于复方制剂的药物是
A. 柳氮磺吡啶
B. 铝碳酸镁
C. 地衣芽孢杆菌活菌
D. 美沙拉嗪
E. 去氧孕烯炔雌醇

正确答案：E。去氧孕烯炔雌醇

解析：本题考查复方制剂。炔雌醇为雌激素类药，去氧孕烯为短效口服避孕药，两者组成复方制剂去氧孕烯炔雌醇（E对）。